慢性乙型肝炎最重要的治疗是
A. 中医中药治疗
B. 抗纤维化治疗
C. 免疫调节治疗
D. 保肝治疗
E. 抗病毒治疗

正确答案：E。抗病毒治疗

解析：慢性肝病患者应根据具体情况采取综合治疗方案，包括合理地休息和营养、改善和恢复肝功、调节机体免疫、抗病毒、抗纤维化等。其中抗病毒对乙肝患者尤为重要。抗病毒治疗可抑制病毒复制，减轻肝组织病变，改善肝功，提高生活质量，延缓肝硬化、肝衰竭等的发生，延长存活时间。符合适应症者应尽可能进行抗病毒治疗（E对）。中医中药治疗（A错）、抗纤维化治疗（B错）、免疫调节治疗（C错）、保肝治疗（D错）属于辅助治疗手段。